患者，男，60岁，呈典型的“面具脸”，“慌张步态”及“小字症”表现，确诊为帕金森病，患者同时患有闭角型青光眼，不宜选用的治疗帕金森病的药物是
A. 左旋多巴
B. 普拉克索
C. 多奈哌齐
D. 司来吉兰
E. 金刚烷胺

正确答案：A。左旋多巴

解析：本题考查抗帕金森病药。左旋多巴（A错，为本题正确答案）可用于帕金森病，闭角型青光眼、精神病患者禁用。普拉克索（B对）可用于帕金森病，对本药活性成分或任何辅料过敏者禁用。多奈哌齐（C对）用于治疗老年性痴呆症。司来吉兰（D对）可用于帕金森病，胃溃疡患者慎用。金刚烷胺（E对）可用于帕金森病，哺乳期妇女禁用。